严重肝功能障碍诱发DIC主要是由于
A. 合成凝血因子增多
B. 灭活活化的凝血因子能力增强
C. 合成蛋白质C增多
D. 合成凝血酶Ⅲ增多
E. 以上都不是

正确答案：E。以上都不是

解析：严重肝功能障碍诱发DIC主要是由于合成凝血因子减少（A错）、灭活活化的凝血因子能力降低（B错）、合成蛋白质C减少（C错）和合成凝血酶Ⅲ降低（D错）。主要的抗凝物质，如蛋白 C、AT-Ill以及纤溶酶原等均在肝脏合成。F IXa、FXa、FXla 等 凝血因子也在肝脏灭活 。当肝功能严重障碍时，可使凝血、抗凝、纤溶过程失调。因此合成凝血因子减少、灭活活化的凝血因子能力降低、合成蛋白质C减少和合成凝血酶Ⅲ降低是严重肝功能障碍诱发DIC主要原因（ABCD错，E为本题正确答案）。